P-R间期固定，QRS波有脱漏心电图表现的是
A. 三度房室传导阻滞
B. 窦房传导阻滞
C. 一度房室传导阻滞
D. 二度Ⅱ型房室传导阻滞
E. 二度Ⅰ型房室传导阻滞

正确答案：D。二度Ⅱ型房室传导阻滞

解析：二度Ⅱ型房室传导阻滞的心电图特点为窦性P波规则出现。PR间期恒定；正常或延长，无文氏现象。QRS波群部分脱落，房室传导比例常为3∶2、4∶3等（D对）。三度房室传导阻滞心电图特点为房室分离，当心房由窦房结控制时，可见P波规则出现，P波与QRS波群无固定关系，P间期与RR间期各有其固定的规律性。心房率大于心室率，即P波频率高于QRS波群频率。心室由逸搏心律控制。QRS波群形态取决干异位起搏点位置的高低；交界性逸搏心律的起搏点位于希氏束分叉以上，QRS波群形态正常，心室率常为40～60次/min；室性逸搏心律的起搏点位于希氏束分叉以下，QRS波群宽大、畸形，心室率常在40次/min以下（A错）。二度Ⅰ型窦房阻滞又称文氏型阻滞，心电图上见PP间期逐渐缩短，最后突然延长，该长PP间期短于基本PP间期的两倍。二度Ⅱ型窦房阻滞，表现为长PP间期为基本PP间期的整倍数（B错）。一度房室传导阻滞心电图特点为窦性P波之后均伴随QRS波群。PR间期延长：PR间期≥0.21s儿童>0.18s，老年人>0.22s；或PR间期超过相应年龄和心率的正常最高值；或在心率未变的情况下PR间期较原来延长0.04s以上（C错）。二度Ⅰ型房室传导阻滞的心电图特点是窦性P波规律出现。文氏现象：PR间期呈进行性延长，RR间距逐渐缩短，直至出现一次心室漏搏。心室漏搏所致的最长RR间距短于任何2个最短的RR间距之和。漏搏后，房室阻滞得到一定改善，PR间期又缩短，之后又逐渐延长，如此周而复始地出现。房室传导比例常为3∶2、4∶3、5∶4等（E错）。